下列关于拔牙的适应证的相关叙述中，不恰当的是
A. 牙拔除术的适应证是相对的
B. 牙周围骨组织大部分破坏不能治疗者可拔除患牙
C. 无影响的第三磨牙的完全骨阻生
D. 滞留的乳牙影响恒牙正常萌出者应拔除
E. 恶性肿瘤进行放射治疗前，为预防严重并发症而需要拔除的牙

正确答案：C。无影响的第三磨牙的完全骨阻生

解析：因完全骨阻生而被疑为原因不明的神经痛病因者或可疑为病灶牙者，可拔除，无影响的可不做处理。掌握“牙拔除的适应证与禁忌证”知识点。